既是络穴又是八脉交会穴之一的腧穴是
A. 太溪
B. 内关
C. 然谷
D. 太渊
E. 复溜

正确答案：B。内关

解析：内关在手厥阴心包经，为络穴，八脉交会穴，通于阴维脉（B对）；太溪（A错）在足少阴肾经，为输穴，肾之原穴；然谷（C错）在足少阴肾经，为荥穴；太渊（D错）在手太阴肺经，为输穴，肺之原穴，八会穴之脉会；复溜（E错）在足少阴肾经，为经穴。